属于对因治疗的药物作用是
A. 硝苯地平降血压
B. 对乙酰氨基酚降低发热体温
C. 硝酸甘油缓解心绞痛发作
D. 聚乙二醇4000治疗便秘
E. 环丙沙星治疗肠道感染

正确答案：E。环丙沙星治疗肠道感染

解析：本题考查药物的治疗作用。对因治疗是指用药后能消除原发致病因子，治愈疾病的药物治疗。例如，使用抗生素杀灭病原微生物从而控制感染性疾病，如环丙沙星治疗肠道感染（E对）。硝苯地平降血压（A错）、对乙酰氨基酚降低发热体温（B错）、硝酸甘油缓解心绞痛发作（C错）、聚乙二醇4000治疗便秘（D错）均为对症治疗。